拟拔除右下8，经切开去骨后艰难拔除，拔除1周复诊，出现右下唇麻木，创口无感染，为明确诊断需
A. X线片检查
B. 麻醉下搔刮牙槽窝
C. 麻醉下探查牙槽窝
D. 口服抗生素
E. 服用神经营养药

正确答案：A。X线片检查

解析：本题考查牙拔除术中并发症-神经损伤。下颌第三磨牙和下颌管解剖上邻近密切相关，也与拔牙难易，拔牙方法、拔牙技术有关，应通过X线判断下颌管有无损伤确定神经是否有损伤（A对）。若发生拔牙创的慢性感染，应在局麻下彻底的搔刮、冲洗牙槽窝，去除异物及炎性肉芽组织（B错）。拔牙时若发生断根，应探查牙槽窝，寻找断根的位置（C错）。口服抗生素可预防术后感染（D错）。神经损伤后，可服用神经营养药物以促进神经恢复（E错）。